长期使用速尿或利尿酸时易发生
A. 低钾血症
B. 低镁血症
C. 两者均有
D. 两者均无
E. 无

正确答案：C。两者均有

解析：长期使用速尿或利尿酸时钾和镁随尿排出增多可致低钾血症和低镁血症（AB对，故C为本题正确答案）。